鸡冠花的功效是
A. 止带
B. 利尿通淋
C. 解毒敛疮
D. 消肿生肌
E. 清热生津

正确答案：A。止带

解析：本题考查的是鸡冠花的功效。鸡冠花的功效是止带（A对）。鸡冠花：【功效】收敛止血，凉血，止带，止痢。白茅根：【功效】凉血止血，清热生津（E错），利尿通淋（B错）。地榆：【功效】凉血止血，解毒敛疮（C错）。白及：【功效】收敛止血，消肿生肌（D错）。